下列中西药中，联合用药协同增效的是
A. 健胃消食片与红霉素
B. 丹参注射液与能量合剂
C. 磁朱丸与诺氟沙星
D. 参茸片与格列喹酮
E. 半夏止咳糖浆与地高辛

正确答案：B。丹参注射液与能量合剂

解析：本题考查的是中西联合用药。下列中西药中，联合用药协同增效的是丹参注射液与能量合剂（B对）。丹参注射液、黄芪注射液、川芎嗪注射液等与低分子右旋糖酐、能量合剂等同用，可提高心肌梗死的抢救成功率。健胃消食片与红霉素（A错）联用可影响排泄。健胃消食片含山楂，红霉素在碱性环境下抗菌作用强，当与含山楂制剂合用时，可使血液中pH值降低，导致红霉素分解，失去抗菌作用。参茸片与格列喹酮（D错）联用影响疗效。参茸片含鹿茸，格列喹酮属于磺酰脲类降糖药。甘草、鹿茸具有糖皮质激素样作用，有水钠潴留和排钾效应，还能促进糖原异生，加速蛋白质和脂肪的分解，使甘油、乳酸等各种糖、氨基酸转化成葡萄糖，使血糖升高，从而减弱胰岛素、甲苯磺丁脲、格列本脲等降糖药的药效。因此含有甘草、鹿茸的中成药，如人参鹿茸丸、全鹿丸等，不能与磺酰脲类降糖药联用。半夏止咳糖浆与地高辛（E错）联用影响疗效。半夏止咳糖浆含麻黄碱，含麻黄碱的中药及其中成药，如复方川贝精片、莱阳梨止咳糖浆、复方枇杷糖浆等，不可与强心药、降压药联用。因麻黄碱会兴奋心肌β受体、加强心肌收缩力，与洋地黄、地高辛等联用时，可使强心药的作用增强，毒性增加，易致心律失常及心衰等毒性反应，同时麻黄碱也有兴奋α受体和收缩周围血管的作用，使降压药作用减弱，疗效降低，甚至使血压失去控制，可加重高血压患者的病情。磁朱丸与诺氟沙星（C错）的配伍效果，2022年考试指南未明确说明。